窝沟封闭失败的最主要原因是
A. 清洁不彻底
B. 酸蚀时间不够
C. 酸蚀后唾液污染
D. 固化时间短
E. 涂布封闭剂有气泡

正确答案：C。酸蚀后唾液污染

解析：封闭前保持牙面干燥，不被唾液污染是封闭成功的关键。实践证明使用棉卷可做到很好的隔湿，其他还可采用专门提供的三角形吸湿纸板或橡皮障等。隔湿在很大程度上也依靠患者的合作。掌握“窝沟封闭术”知识点。